下述对牙根形态的生理意义叙述，哪一点是不正确的
A. 上颌磨牙舌尖受力最大，故舌根比颊根大
B. 根分叉越多，其支持作用越大
C. 上颌切牙受向上前的力，故唇面小于舌面
D. 根分叉越宽，其支持作用越强
E. 下颌磨牙根横截面呈葫芦形，有利于稳固

正确答案：C。上颌切牙受向上前的力，故唇面小于舌面

解析：本题考查牙根形态的生理意义。下述对牙根形态的生理意义叙述不正确的是上颌切牙受向上前的力，故唇面小于舌面（C错，为本题的正确答案）。上颌磨牙舌尖受力最大，舌根比颊根大（A对）；磨牙受力较大，是多根牙（B对），根分叉较宽（D对），能承受较大的（牙合）力；切牙承受向前向上的力，牙根唇面宽于舌面，以抵御向前的力；下颌磨牙的牙根横断面为“8”字行，即葫芦形，近远中面有长行凹陷，牙槽骨嵌入其中增强固位，以抵御各种方向的力（E对）。